酶活性中心以外必需基团的功能是
A. 结合多个底物分子
B. 调控其他的酶活性
C. 维持酶活性中心的空间结构
D. 加快催化反应
E. 生成成肽键

正确答案：C。维持酶活性中心的空间结构

解析：酶的活性中心或酶的活性部位，是酶分子中能与底物特异结合并催化底物转变为产物的具有特定三维结构的区域，有些必需基团位于酶的活性中心内，有些必需基团位于酶的活性中心外。酶活性中心外的必基团参与维持酶活性中心的空间结构（C对）。酶活性中心内的必需基团可有结合基团和催化基团之分，前者的作用是识别与结合底物和辅酶（A错），形成酶－底物过渡态复合物，后者的作用是影响底物中的某些化学键的稳定性（BE错），催化底物发生化学反应（D错），进而转变成产物。